常用于黄酮或黄酮醇类化合物检识的试验是
A. 碘化铋钾试验
B. 盐酸-镁粉试验
C. 无色亚甲蓝试验
D. Liebermann试验
E. 异羟肟酸铁试验

正确答案：B。盐酸-镁粉试验

解析：本题考查的是黄酮的显色反应。常用于黄酮或黄酮醇类化合物检识的试验是盐酸-镁粉试验（B对）。黄酮的盐酸-镁粉（或锌粉）反应：是鉴别黄酮类化合物最常用的颜色反应。多数黄酮、黄酮醇、二氢黄酮及二氢黄酮醇类化合物显橙红色至紫红色，少数显紫色至蓝色。但查尔酮、橙酮、儿茶素则无该显色反应。异黄酮类化合物除少数例外，也不显色。碘化铋钾试验（A错）为生物碱的沉淀反应。碘化铋钾试剂在酸水或稀醇中与生物碱可生成黄色至橘红色无定形沉淀。无色亚甲蓝试验（C错）为醌类化合物的显色反应。无色亚甲蓝显色试验：无色亚甲蓝乙醇溶液（1mg/ml）专用于检出苯醌及萘醌。样品在白色背景下呈现出蓝色斑点，可与蒽醌类区别。Liebermann试验（D错）为皂苷的显色反应。Liebermann反应：样品溶于醋酐中，加入1滴浓硫酸，呈黄→红→蓝→紫→绿等颜色变化，最后褪色。异羟肟酸铁试验（E错）为香豆素的显色反应。异羟肟酸铁反应：由于香豆素类具有内酯环，在碱性条件下可开环，与盐酸羟胺缩合成异羟肟酸，然后再在酸性条件下与三价铁离子络合成盐显红色